指出有关硬脑膜窦的错误描述
A. 由两层硬脑膜构成
B. 窦内有静脉血
C. 上矢状窦汇入窦汇
D. 直窦汇入上矢状窦
E. 乙状窦续于横窦

正确答案：D。直窦汇入上矢状窦

解析：硬脑膜窦由两层硬脑膜构成（A对），内面衬以内皮细胞，窦内有静脉血（B对）。主要的硬脑膜窦包括上矢状窦、下矢状窦、直窦、窦汇、横窦、乙状窦、海绵窦。根据硬脑膜窦内血液回流的特点得知，上矢状窦汇入窦汇（C对）、乙状窦续于横窦（E对）、直窦汇入窦汇（D错，为本题正确答案）。